CD4⁺Th细胞活化的第一信号是
A. 表达IL-12，IL-2，IL-4的受体
B. TCR识别肽Ag MHCⅡ类分子复合物
C. CD4⁺Th与APC间黏附分子的作用
D. IL-12作用
E. IL-1的作用

正确答案：B。TCR识别肽Ag MHCⅡ类分子复合物